阿托品对哪种平滑肌的松弛作用最强
A. 胃肠道
B. 胆管
C. 支气管
D. 输尿管
E. 幽门括约肌

正确答案：A。胃肠道

解析：阿托品对多种内脏平滑肌有松弛作用，尤其对过度活动或痉挛的平滑肌作用更为显著。它可抑制胃肠道平滑肌痉挛，降低蠕动的幅度和频率，缓解胃肠绞痛。掌握“阿托品”知识点。